患者，男，50岁，诊断为高血压、冠心病。医师处方，氨氯地平片10mgpoqd；美托洛尔缓释片47.5mgpoqd；贝那普利片20mgpoqd；阿司匹林肠溶片100mgpoqd；辛伐他汀片40mgpoqd。该患者对阿司匹林不耐受，可选用的替代药物是
A. 华法林片
B. 双嘧达莫片
C. 氯吡格雷片
D. 对乙酰氨基酚片
E. 布洛芬胶囊

正确答案：C。氯吡格雷片

解析：本题考查氯吡格雷。阿司匹林的最佳剂量范围为75～150mg/d，主要不良反应为胃肠道出血或对阿司匹林过敏，不能耐受阿司匹林的患者可改用氯吡格雷（C对）作为替代治疗。华法林（A错）属于香豆素类口服抗凝血药物，不建议阿司匹林与华法林联合应用。双嘧达莫（B错）与阿司匹林有协同作用，故不宜使用。对乙酰氨基酚（D错）、布洛芬（E错）均为解热镇痛药，不具有抗血栓作用。